某患外科手术时输血500ml，近日出现黄疸，并伴肝区痛，食欲缺乏，厌油食等症状。查抗HCV-IgM（﹢），最可能的印象诊断是
A. 甲型肝炎
B. 乙型肝炎
C. 丙型肝炎
D. 丁型肝炎
E. 戊型肝炎

正确答案：C。丙型肝炎